男，56岁。饮酒史30余年。20年前下岗后饮酒逐渐增加，每天白酒1斤，从未间断。进食少，体型消瘦。能间断外出打零工，生活基本正常。10年前常无故怀疑妻子有外遇。近2年记忆力明显下降，易忘事。4天前患者被摩托车撞伤致轻微骨折，住院拟行手术治疗，故停酒3天。昨晚患者看见地板上有各种虫子在爬，大喊大叫称床底下着火了，紧张害怕。不认识爱人，不知道自己在什么地方。对患者的治疗不正确的是
A. 补充大量B族维生素
B. 大剂量抗精神病药物治疗
C. 给予保护性约束
D. 苯二氮䓬类药物替代治疗
E. 输液营养支持治疗

正确答案：B。大剂量抗精神病药物治疗

解析：中年男性患者，急性起病、意识障碍、定向障碍、伴波动性认知功能损害，综合患者的症状、体征，初步诊断为谵妄状态。对患者的治疗不正确的是大剂量抗精神病药物治疗（B错，为本题正确答案），因为其可能存在明显并发症的风险。补充大量B族维生素（A对）、输液营养支持治疗（E对）适用于营养缺乏所致的谵妄。给予保护性约束（C对）以防止患者出现意外损伤。苯二氮䓬类药物替代治疗适用于与酒精或镇静催眠类药物戒断相关的谵妄（D对）。